子宫内膜脱落不全
A. 月经周期正常，量少
B. 月经中期出血，量少
C. 月经间隔时间正常，但经期延长9-10天，量多
D. 月经周期紊乱，经期长短不一，出血时多时少
E. 月经周期缩短，月经频发

正确答案：C。月经间隔时间正常，但经期延长9-10天，量多

解析：子宫内膜不规则脱落由于下丘脑-垂体-卵巢轴调节功能紊乱，或溶黄体机制失常，引起黄体萎缩不全，而内膜持续受孕激素影响，不能如期完整脱落。正常月经第3～4日时，分泌期子宫内膜已全部脱落。黄体萎缩不全时，月经期第5～6日仍能见到呈分泌反应的子宫内膜，常表现为残留的分泌期内膜与出血坏死组织及新增生的内膜混合共存。所以表现为月经间隔时间正常，但经期延长9-10天，量多（C对）；月经周期正常，量少有可能是流产后造成的子宫内膜的损伤或者宫腔粘连或排卵不正常等原因导致（A错）；月经中期出血，量少通常是由于排卵期体内的雌性激素和孕激素均降到相对最低的状态，子宫内膜失去雌孕激素的支撑，就造成了撤退性的出血（B错）；月经周期紊乱，经期长短不一，出血时多时少是功能失调性子宫出血的临床表现（D错）；月经周期缩短，月经频发可能是黄体功能不全、卵泡期缩短、卵巢储备功能不良等原因造成的（E错）。